匹维溴铵片治疗胆石症，正确的用药方法是
A. 餐后半小时服用
B. 清晨空腹整片吞服，并保持上身直立的坐位或站位至少30分钟
C. 睡前服用
D. 餐前1小时嚼碎服用
E. 进餐时整片吞服

正确答案：E。进餐时整片吞服

解析：本题考查匹维溴铵片的使用。匹维溴铵片进餐时整片吞服（E对），不可咀嚼或掰嚼，不宜卧位或睡前服用。